胸腺非依赖性抗原（TI-Ag）是指
A. 无需B细胞辅助即可直接刺激T细胞产生抗体的抗原
B. 无需T细胞辅助即可直接刺激B细胞产生抗体的抗原
C. 无需T细胞辅助即可直接刺激T细胞产生抗体的抗原
D. 刺激B细胞产生高水平抗体产生时依赖T细胞辅助的抗原
E. 刺激外源细胞产生高水平抗体产生时依赖T细胞辅助的抗原

正确答案：B。无需T细胞辅助即可直接刺激B细胞产生抗体的抗原

解析：胸腺非依赖性抗原（TI-Ag）是指无需T细胞辅助即可直接刺激B细胞产生抗体的抗原。掌握“抗原基本概念、分类、超抗原及佐剂”知识点。